松果体叙述错误的是
A. 分为内分泌腺和内分泌组织
B. 内分泌腺无排泄导管
C. 儿童期较发达
D. 促进性成熟
E. 成年后钙化

正确答案：D。促进性成熟

解析：松果体为一灰红色的椭圆形内分泌腺体，分为内分泌腺和内分泌组织（A对），表面包以软脑膜，结缔组织伴随血管伸人腺实质内，将实质分为许多小叶，内分泌腺无排泄导管（B对）。松果体在儿童期较发达（C对），一般在7岁左右开始退化，青春期后松果体可有钙盐沉积（E对），出现大小不一的脑砂。松果体合成和分泌褪黑素，其可拟制垂体促性腺激素的释放，间接影响性腺的发育（D错，为本题正确答案）。